我国唐代《新修本草》中记录银膏补牙，是为了治疗
A. 根尖周炎
B. 牙周病
C. 颌骨囊肿
D. 龋病
E. 牙体磨耗

正确答案：D。龋病

解析：本题考查龋病概述。我国古代医学中不仅对龋病早有认识，而且有丰富的治疗经验。我国唐代《新修本草》一书中有采用银膏补牙的记录，所治疗的疾病为龋齿（D对）。